女孩，2岁，自幼体弱，多次患肺炎。胸部X线片：左心房、左心室增大，肺野充血，主动脉影增宽，最可能的诊断是
A. 艾森门格综合征
B. 法洛四联症
C. 动脉导管未关闭
D. 房间隔缺损
E. 室间隔缺损

正确答案：C。动脉导管未关闭

解析：女性幼儿，自幼体弱，多次患肺炎（免疫力低下）。胸部X线片见左心房、左心室増大，肺野充血，主动脉影增宽。根据患者病史、体格检查及影像学检查，怀疑为动脉导管未关闭。动脉导管未关闭X线表现为左心室增大，心尖向下扩张，左心房亦轻度增大。肺血增多，肺动脉段突出，肺门血管影增粗，可有主动脉节正常或凸出（C对）。艾森曼格综合征X线表现为肺动脉主支增粗，而肺外周血管影很少，心影可基本正常或轻度增大（A错）。法洛四联症由四种畸形组成：右心室流出道梗阻，室间隔缺损，主动脉骑跨，右心室肥厚。其X线表现为心尖圆钝上翘的“靴形”心，肺动脉段凹陷，肺门血管影缩小，两侧肺纹理减少（B错）。房间隔缺损X线表现为心脏外形轻至中度增大，以右心房及右心室为主，肺动脉段突出，肺野充血明显，主动脉影缩小（D错）。室间隔缺损X线表现为左右心室增大，肺动脉段突出，肺野充血（E错）。